功能疏肝解郁的药物有
A. 薄荷
B. 蝉蜕
C. 柴胡
D. 葛根
E. 菊花

正确答案：A、C。薄荷；柴胡

解析：本题考查的是薄荷与柴胡的性能特点与功效。功能疏肝解郁的药物有薄荷（A对）与柴胡（C对）。薄荷：【性能特点】本品辛疏散，香辟秽，凉能清。入肺、肝经，既疏散风热而清利头目与咽喉、透疹，又疏肝解郁、辟秽。发汗力较强，尤善清利头目。治风热袭表或上攻者最宜，治肝郁化热可投。【功效】宣散风热，清利头目，利咽，透疹，疏肝。柴胡：【性能特点】本品苦泄辛散，芳疏性升，微寒能清，入肝、胆经。既疏散胆经邪气而和解退热，又疏散肝胆经郁结之气而疏肝解郁，还升举肝胆清阳之气而举陷，为肝胆经之主药。生用既升散又清泄，醋制升散清泄力减而疏肝力增。【功效】解表退热，疏肝解郁，升举阳气。蝉蜕（B错）：【性能特点】本品甘寒质轻，清宣透散。入肺、肝经，既疏散风热而利咽疗哑、止痒透疹、明目退翳，又息内风而止痉抽。既散外来之风热，又息内生之肝风，凡风热、肝风所致病证皆宜。发汗不及薄荷，清热不及牛蒡子，长于息风止痉，且味不苦易服。【功效】疏散风热，透疹止痒，明目退翳，息风止痉。葛根（D错）：【性能特点】本品甘辛轻扬升散，平而偏凉能清，入脾、胃经。既透解肌表风热、解肌退热而发表、透发疹斑，又鼓舞脾胃清阳上升而生津止渴、升阳止泻。治项背强痛与阳明头痛最宜，无论寒热虚实、有汗无汗皆可。生用升散清透并生津，煨用长于升举而少清透。【功效】解肌退热，透疹，生津，升阳止泻。菊花（E错）：【性能特点】本品香疏苦泄，甘能益润，微寒能清，入肝、肺经。主疏散清解，兼益润平降。既清散风热而解表，又益阴平肝而明目，还清泄热邪而解毒。主治风热、肝热、热毒所致诸证。黄者名杭菊花，白者名滁菊花。【功效】疏散风热，平肝明目，清热解毒。